SARS早期的表现是
A. 头痛，肌肉关节酸痛
B. 发热
C. 干咳胸痛、乏力
D. 胸闷、乏力
E. 呼吸困难

正确答案：B。发热

解析：SARS早期，一般为病初的1～7天，起病急，首发症状为发热（B对），体温一般高于38℃，半数以上伴有头痛、肌肉关节酸痛（A错）、乏力等症状，部分有胸痛干咳（CDE错），肺部体征不明显，少有呼吸道卡他症状，部分患者可闻及少许湿啰音。